下列不属于自然灾害的是
A. 海洋灾害
B. 工业火灾
C. 水旱灾害
D. 地震灾害
E. 生物灾害

正确答案：B。工业火灾